继发性牙本质不均匀分布，常见于牙齿的什么部位
A. 髓腔（髓室）内侧
B. 冠部釉牙本质界
C. 根部牙本质牙骨质界
D. 根尖处牙本质牙骨质界
E. 颈部的釉牙骨质界

正确答案：A。髓腔（髓室）内侧

解析：继发性牙本质在髓腔特别是髓室内侧，不均匀分布，受刺激较大的区域继发性牙本质形成的较多。掌握“牙本质”知识点。